使青霉素G的半衰期长达3小时的儿童发育阶段是
A. 早产儿
B. 新生儿
C. 婴幼儿
D. 儿童
E. 成年人

正确答案：B。新生儿